治疗淋病正虚毒恋证的主方是
A. 龙胆泻肝汤
B. 知柏地黄丸
C. 萆薢渗湿汤
D. 萆薢化毒汤
E. 清营汤

正确答案：B。知柏地黄丸

解析：慢性淋病病程日长，耗伤正气，正气虚弱，无力驱毒外出，形成正虚毒恋之证，知柏地黄丸即可滋补真阴，又可降虚火，尤善治疗阴虚毒恋的淋病（B对）。龙胆泻肝汤具有清泻肝胆实火，清利肝经湿热之功效，适于湿热毒蕴的淋病、湿热下注的热疮、肝经郁热的蛇串疮、湿热内蕴的风瘙痒、湿热蕴结的猫眼疮、肝经湿热的梅毒、生殖器疱疹（A错）。萆薢渗湿汤具有清热利湿之功，适于湿热蕴肤的药毒、湿毒蕴阻的银屑病（C错）。萆薢化毒汤具有利湿化浊，清热解毒之功，适于湿热下注的尖锐湿疣（D错）。清营汤具有清营解毒，透热养阴之功效，适于热毒入营的药毒（E错）。